A和B两种表面活性剂的HLB值分别为16.6和18.2，两者等量混合的HLB值是
A. 11
B. 17.4
C. 34.8
D. 58.2
E. 69.6

正确答案：B。17.4

解析：本题考查HLB的计算。非离子表面活性剂的HLB值具有加和性，混合后HLB=（HLBₐWₐ+HLBₑWₑ）/（Wₐ+Wₑ），题中两种表面活性剂等量混合，故HLB=（16.6+18.2）/2=17.4（B对）。